新生儿颌骨骨髓炎的感染来源多为
A. 腺源性
B. 血源性
C. 损伤性
D. 牙源性
E. 医源性

正确答案：B。血源性

解析：本题考查新生儿颌骨骨髓炎的感染来源。新生儿颌骨骨髓炎一般指发生在出生后3个月以内的化脓性中央性颌骨骨髓炎。新生儿的骨髓炎以血源性感染最为多见（B对），主要通过脐带感染。